患者，女，59岁，一月前患胃溃疡，近日查体发现血脂异常，化验结果：TC7.2mmol/L，TG1.7mmol/L，LDL-C4.3mmol/L，ALT56U/L，AST80U/L。该患者首选的调脂药是
A. 非诺贝特片
B. 阿托伐他汀钙片
C. 普罗布考片
D. 阿昔莫司胶囊
E. 烟酸缓释胶囊

正确答案：B。阿托伐他汀钙片

解析：本题考查调脂药。该患者首选的调脂药是阿托伐他汀钙片（B对）。他汀类主要降低血清TC和LDL-C，也在一定程度上降低TG，轻度升高HDL-C水平，故该患者首选的调脂药是阿托伐他汀钙片。非诺贝特片（A错）用于治疗成人饮食控制疗法效果不理想的高脂血症。普罗布考片（C错）用于治疗高胆固醇血症。阿昔莫司胶囊（D错）用于治疗高甘油三酯血症（Ⅳ型），高胆固醇血症（Ⅱa型）、高甘油三酯合并高胆固醇血症（Ⅱb型）。烟酸缓释胶囊（E错）用于对于因高胆固醇血症而处于心血管疾病高危状态中的患者。